化妆品变应性接触性皮炎的发生取决于
A. 化妆品本身的化学刺激作用和使用者本身的特异体质
B. 化妆品含有的变应原物质和使用者的皮肤状况
C. 使用者本身的特异体质和皮肤状况
D. 化妆品含有的变应原物质和使用者本身的特异体质
E. 化妆品本身的化学刺激作用和使用者的皮肤状况

正确答案：D。化妆品含有的变应原物质和使用者本身的特异体质

解析：本题考查化妆品变应性接触性皮炎的发生因素。变应性接触性皮炎是化妆品中含有变应原物质，可刺激机体免疫系统产生以T细胞介导的皮肤迟发型变态反应性组织损伤。化妆品变应性接触性皮炎的发生取决于化妆品含有的变应原物质和使用者本身的特异体质（D对ABCE错）。